妊娠期母体生理变化最大最明显的是
A. 输卵管
B. 阴道
C. 乳房
D. 子宫
E. 卵巢

正确答案：D。子宫

解析：妊娠时子宫变化最大。肌纤维肥大、变长、增生至宫体逐渐增大。妊娠末期，由未孕期时的40～50g增至约1000g，容量增加约500倍。血流量逐渐增加，足月妊娠时每分钟达500～700mL（D对）。输卵管血运增加，组织变软，粘膜有时呈类似蜕膜样变（A错）。阴道肌纤维及弹力纤维增生，易于扩张。粘膜变厚，充血，呈紫兰色，分泌物增多，呈酸性，可抑制致病菌生长（B错）。妊娠最早几周感乳房发胀，或有刺痛感及触痛，妊娠8周后乳房明显增大。由于雌激素及孕激素的增加，乳房腺管与腺体皆增生，脂肪沉积，乳头很快增大、着色、乳晕着色、出现散在的皮脂腺肥大隆起。妊娠后期可由乳头挤出少量黄色液体，称"初乳"（C错）。卵巢 略增大，不排卵。在一侧卵巢中有妊娠黄体继续生长并分泌雌激素和孕激素。妊娠黄体一般在妊娠3个月后开始萎缩，由胎盘替代卵巢分泌激素（E错）。